如果某幼儿园发生甲型肝炎暴发，应立即采取的措施不包括
A. 救治患儿，向相关机构报告疫情，停供现有食物和饮用水
B. 保育人员中的甲肝患者须立即隔离治疗，痊愈后方可恢复工作
C. 对密切接触者应急接种人免疫球蛋白，以预防及减少甲肝临床型感染
D. 采取适当方式隔离所有甲肝患儿，并对密切接触者进行医学观察
E. 全体幼儿和保育人员接种甲肝疫苗

正确答案：E。全体幼儿和保育人员接种甲肝疫苗

解析：本题考查甲型肝炎暴发应立即采取的措施。如果幼儿园发生甲型肝炎暴发，应立即采取的措施包括：1.救治患儿，向相关机构报告疫情，停供现有食物和饮用水（A对）；2.采取适当方式隔离所有甲肝患儿，并对密切接触者进行医学观察（D对）；3.保育人员中的甲肝患者须立即隔离治疗，痊愈后方可恢复工作（B对）；4.对密切接触者应急接种人免疫球蛋白，以预防及减少甲肝临床型感染（C对）。全体幼儿和保育人员接种甲肝疫苗（E错，为本题正确答案）可以提高人群免疫力，预防甲肝的发生和暴发流行。